心包摩擦音通常在什么部位听诊最清楚
A. 心尖部
B. 心底部
C. 胸骨左缘第三、四肋间
D. 胸骨右缘第三、四肋间
E. 左侧腋前线三、四肋间

正确答案：C。胸骨左缘第三、四肋间

解析：心包摩擦音可在整个心前区听到，但以胸骨左缘第三、四肋间听诊最清楚（C对DE错）。第一心音在心尖部听诊最清楚（A错）。第二心音在心底部听诊最清楚（B错）。